下列不属于口腔颌面外科手术的全麻方法的是
A. 吸入麻醉
B. 静脉麻醉
C. 肌肉注射
D. 基础麻醉
E. 静脉吸入

正确答案：C。肌肉注射

解析：口腔颌面外科手术的全麻方法可分为：吸入麻醉、静脉麻醉、基础麻醉、静脉吸入复合麻醉和全凭静脉复合麻醉。掌握“全身麻醉”知识点。